苯的主要蓄积部位是
A. 骨骼
B. 肾脏
C. 肝脏
D. 骨髓
E. 神经组织

正确答案：D。骨髓

解析：苯为脂溶性物质，在含脂肪丰富的组织如骨髓（D对）内蓄积较多，对骨髓中核分裂最活跃的原始细胞具有更明显的毒作用。